子宫内膜增生早期，其内膜厚度为
A. 1～2mm
B. 3～4mm
C. 5～6mm
D. 7～8mm
E. 8～10mm

正确答案：A。1～2mm

解析：月经周期的第5～14日是子宫内膜的增殖期，分为增殖早期、增值中期和增殖晚期。增殖早期子宫内膜较薄，仅1～2mm（A对）；增殖晚期子宫内膜增至3～5mm。